男，62岁。腹胀、右下腹部隐痛6个月。阵发性隐痛，乏力，消瘦，近3个月贫血，首先应考虑的诊断是
A. 小肠肿瘤
B. 克罗恩病
C. 溃疡性结肠炎
D. 降结肠癌
E. 升结肠癌

正确答案：E。升结肠癌

解析：老年患者右下腹隐痛，乏力、消瘦（全身症状），贫血，应首先考虑升结肠癌（E对）。小肠肿瘤（A错）临床表现极不典型，发病率远较胃肠道其他部位低，不宜首先考虑。克罗恩病（B错）以年轻患者为主，肠梗阻多见。溃疡性结肠炎（C错）多表现为左下腹隐痛，临床表现以腹泻、黏液脓血便和腹痛为主。降结肠癌（D错）多表现为肠梗阻、便秘、腹泻等。